有关泪液，正确的说法是
A. 由位于眶内下份的泪腺分泌
B. 其分泌由眼神经的泪腺神经管理
C. 泪液可经鼻泪管流入下鼻道
D. 泪液经泪腺小管流入结膜下穹
E. 其分泌由下泌涎核控制

正确答案：C。泪液可经鼻泪管流入下鼻道

解析：泪液由位于眼眶外上方的泪腺窝内的泪腺分泌，而非由位于眶内下份的泪腺分泌（A错），其分泌由上泌涎核的副交感神经节后纤维管理，而非由眼神经的泪腺神经管理（B错）。泪液经泪（腺）小管流入泪囊，而非流入结膜下穹（D错），后经鼻泪管流入下鼻道（C对）。下泌涎核控制腮腺的分泌（E错），而非泪液的分泌。